急性阑尾炎的体征中最有诊断意义的是
A. 右腹肌紧张
B. 转移性腹痛和右下腹部压痛
C. 右腹Murphy征阳性
D. 腰大肌试验阳性
E. 闭孔内肌试验阳性

正确答案：B。转移性腹痛和右下腹部压痛